哪个牙与相邻恒磨牙的形态相似
A. 上颌乳尖牙
B. 下颌乳尖牙
C. 上颌乳中切牙
D. 上颌第二乳磨牙
E. 下颌第一乳磨牙

正确答案：D。上颌第二乳磨牙

解析：上颌第二乳磨牙与下颌第二乳磨牙分别与同颌的第一恒磨牙形态近似，位置彼邻，易混淆。掌握“上下颌前牙的外形及临床应用解剖”知识点。